梅毒的病原体是
A. 人乳头瘤病毒
B. 沙眼衣原体
C. 苍白螺旋体
D. 淋病奈瑟菌
E. 纤细螺旋体

正确答案：C。苍白螺旋体

解析：本题考查常见性传播疾病及其病原体。梅毒的病原体是苍白螺旋体（C对ABDE错），主要相关疾病有：一期溃殇（下疳）伴局部淋巴结肿大、皮疹、扁平湿疣、骨、心血管和神经系统损害； 妊娠失败（流产、死胎）、早产；死胎、先天梅毒。